关于阴道自净作用不正确的是
A. 正常情况下阴道有自净能力
B. 使阴道酸碱度保持在酸性
C. 使在碱性坏境中生存的微生物不能在阴道内生长繁殖
D. 阴道上皮含有糖原，在阴道内乳酸杆菌的作用下将单糖转化成乳酸
E. 阴道自净作用指阴道内巨噬细胞吞噬阴道内病原体

正确答案：E。阴道自净作用指阴道内巨噬细胞吞噬阴道内病原体

解析：正常情况（生理情况）下阴道有自净能力（A对），即雌激素使阴道上皮增生变厚并增加阴道上皮细胞内的糖原含量，阴道上皮细胞分解糖原为单糖，在阴道内乳酸杆菌的作用下将单糖转化成乳酸（D对），使阴道酸碱度保持在酸性（B对），使在碱性坏境中生存的微生物不能在阴道内生长繁殖（C对）（E错，为本题正确答案）。